引起年长儿化脓性脑膜炎最常见的致病菌是
A. 肺炎链球菌
B. 流感嗜血杆菌
C. 大肠埃希菌
D. 金黄色葡萄球菌
E. 隐球菌

正确答案：A。肺炎链球菌

解析：引起年长儿化脓性脑膜炎往往是由继发于由肺炎链球菌（A对）引起的肺炎球菌肺炎。流感嗜血杆菌（P403）（B错）引起的脑膜炎多见于2个月至2岁儿童。肠道革兰阴性杆菌如大肠埃希菌（C错）和金黄色葡萄球菌（D错）是引起新生儿化脓性脑膜炎致病菌。隐球菌（P404）（E错）属真菌类，不引起化脓性脑膜炎。